男性，65岁。陈旧性广泛前壁心肌梗死7年，活动后胸闷、心悸、气短2年，近1周出现夜间阵发性呼吸困难。体检：端坐呼吸，BP160/90mmHg，P120次/分。P₂亢进，心脏各瓣膜区未闻及杂音。双肺底可闻及细湿啰音，双肺散在哮鸣音。腹平软，肝脾肋下未触及，双下肢无水肿。空腹血糖4.2mmol/L。心电图：V₁～V₆导联ST段压低0.05～0.1mV。血清肌钙蛋白I正常。住院期间测餐后血糖三次，餐后2小时血糖为14.0～16.0mmol/L，其降压药物宜首选
A. 血管紧张素转换酶抑制剂
B. 利尿剂
C. α受体阻滞剂
D. 钙通道阻滞剂
E. 硝酸酯类药物

正确答案：A。血管紧张素转换酶抑制剂

解析：患者老年男性，既往有活动后胸闷心悸气短，近1周出现夜间阵发性呼吸困难，端坐呼吸，P₂亢进，双肺底可闻及细湿啰音，双肺散在哮鸣音，该患者目前最可能的诊断是急性左心衰竭。糖尿病症状+任意时间静脉血浆葡萄糖≥11.1mmol/L或空腹血浆葡萄糖≥7.0mmol/L或OGTT2小时血糖≥11.1mmol/L。再重复一次，即可诊断糖尿病（P733）。本患者住院期间测餐后血糖三次，餐后2小时血糖为14.0～16.0mmol/L，可诊断为糖尿病。对于高血压合并心力衰竭和糖尿病的患者降压药宜首选血管紧张素转换酶抑制剂（A对）。利尿剂（B错）和钙通道阻滞剂（D错）也可用于高血压合并糖尿病的患者（P253-P254），但并非首选药物。α受体阻滞剂（C错）通过阻断血管平滑肌α₁受体和直接舒张血管平滑肌作用，使血管扩张，外周阻力降低，血压下降，但临床多用于血管痉挛性疾病如闭塞性脉管炎、雷诺症（肢体动脉痉挛）及冻伤后遗症等，也可用于肾上腺嗜铬细胞瘤所引起的高血压危象及术前治疗（P712）。硝酸酯类药物（P258）（E错）可用于心绞痛的抗缺血治疗，在高血压的治疗中，多用于治疗高血压急症伴急性心力衰竭或急性冠脉综合症。